抑制胆碱酯酶的药物是
A. 扑米酮
B. 司来吉兰
C. 可待因
D. 多奈哌齐
E. 加巴喷丁

正确答案：D。多奈哌齐

解析：本题考查多奈哌齐。多奈哌齐（D对）为乙酰胆碱脂酶抑制剂；扑米酮（A错）是巴比妥类抗癫痫药，作用于GABA受体；司来吉兰（B错）是选择性单胺氧化酶抑制剂；可待因（C错）是阿片受体激动剂；加巴喷丁（E错）是GABA氨基转移酶抑制剂，用于治疗癫痫。